唇的结构由外向内可分为
A. 黏膜、黏膜下层、浅筋膜、肌层、皮肤
B. 黏膜、浅筋膜、肌层、黏膜下层、皮肤
C. 皮肤、浅筋膜、肌层、黏膜、黏膜下层
D. 皮肤、肌层、浅筋膜、黏膜下层、黏膜
E. 皮肤、浅筋膜、肌层、黏膜下层、黏膜

正确答案：E。皮肤、浅筋膜、肌层、黏膜下层、黏膜

解析：唇的结构由外向内分为五层：皮肤、浅筋膜、肌层、黏膜下层、黏膜。掌握“口腔境界及唇、颊的局部解剖”知识点。